驱铅治疗的首选药物是
A. 亚硝酸钠
B. 依地酸二钠钙
C. 阿托品
D. 亚甲蓝
E. 青霉胺

正确答案：B。依地酸二钠钙